患者，女，34岁，已婚。自然流产3次，现又停经42天，尿妊娠试验阳性。晨起恶心，近2天又有阴道出血，量少、色淡黯，伴头晕耳鸣，双腿酸软，舌淡苔白，脉沉滑尺弱。治疗应首选
A. 胎元饮
B. 泰山磐石散
C. 加味阿胶汤
D. 举元煎
E. 寿胎丸

正确答案：E。寿胎丸

解析：患者曾自然流产三次，先停经42天，为早孕期，阴道出血，量少，色黯淡是为肾虚冲任失固，肾失温煦，血失阳化；并伴有头晕耳鸣，双腿酸软，舌淡苔白等肾虚之象，是胎漏胎动不安之肾虚证，治疗用寿胎丸补肾健脾，益气安胎（E对）。胎元饮功效补气养血，固肾安胎，多用于胎漏、胎动不安之气血虚弱证（A错）。泰山磐石散原方治妇人妊娠，气血两虚的胎动不安或屡孕屡堕，功效为益气养血，固冲安胎，多用于滑胎之气血虚弱证（B错）。加味阿胶汤补肾益阳，温煦水液，治疗肾虚小便多等肾虚之证（C错）。举元煎功效补气摄血固冲，原方治疗气虚下陷，血崩气脱，亡阳垂危等证，本方实为补中益气汤的缩方，补气力专，多用于气虚较甚之征，且方中无滋阴养血之当归，用于月经过多气虚证（D错）。